疗效高，生效快，控制疟疾症状首选
A. 氯喹
B. 奎宁
C. 伯氨喹
D. 乙胺嘧啶
E. 甲氟喹

正确答案：A。氯喹